苯扎溴铵在外用液体制剂中作为
A. 潜溶剂
B. 助悬剂
C. 防腐剂
D. 助溶剂
E. 增溶剂

正确答案：C。防腐剂

解析：本题考查防腐剂。苯扎溴铵在外用液体制剂中作为防腐剂（C对）。潜溶剂（A错）系指能形成氢键以增加难溶性药物溶解度的混合溶剂；助悬剂（B错）是指能增加混悬剂中分散介质的黏度，降低药物微粒的沉降速度或增加微粒亲水性的附加剂；难溶性药物与加入的第三种物质在溶剂中形成可溶性分子间的络合物、缔合物或复盐等，以增加药物在溶剂中的溶解度，这第三种物质称为助溶剂（D错）；具增溶能力的表面活性剂称为增溶剂（E错）。